口腔健康促进的基础是
A. 一级预防
B. 二级预防
C. 三级预防
D. 社区预防
E. 高危及易感人群的特殊防护

正确答案：A。一级预防

解析：口腔疾病预防在口腔健康促进中起着重要作用。口腔健康促进应以口腔疾病的一级预防方法为基础。这也是口腔健康促进的主要任务。掌握“口腔健康促进”知识点。